革兰氏阴性菌，复红可染成
A. 红色
B. 黄色
C. 蓝色
D. 绿色
E. 紫色

正确答案：A。红色

解析：凡未被95%乙醇脱色，菌体被结晶紫和复红染成紫色者为革兰氏阳性菌，而经乙醇脱色后，被复红染成红色者为革兰氏阴性菌。掌握“细菌的特殊结构及检查方法”知识点。